内脏大神经主要终于
A. 肠系膜上神经节
B. 肠系膜下神经节
C. 主动脉肾节
D. 腹腔神经节
E. 奇神经节

正确答案：D。腹腔神经节

解析：内脏大神经由穿过第5或第6-9胸交感干神经节的节前纤维组成，向前下方行走中合成一干，并沿椎体前面倾斜下降，穿过膈脚，主要终于腹腔神经节（D对）。